妊娠期高血压疾病痰火上扰证的治疗方剂为
A. 正气天香散
B. 杞菊地黄丸
C. 半夏白术天麻汤
D. 羚角钩藤汤
E. 牛黄清心丸

正确答案：E。牛黄清心丸

解析：妊娠期高血压病的痰火上扰证由于素体阴虚，阴虚内热，灼津成痰，痰热交织，或素体脾虚或肝郁克脾，脾虚湿聚，郁久化热，痰热雍盛，上扰清窍而发。治宜清热豁痰，息风开窍，方用益气养血，清热镇静，化痰熄风的牛黄清心丸（E对）。妊娠期高血压病阴虚肝旺证的治疗方剂为杞菊地黄丸（B错）《医级》加天麻、钩藤、石决明；妊娠期高血压病脾虚肝旺证的治疗方剂为半夏白术天麻汤（C错）加钩藤、丹参；妊娠期高血压病肝风内动的治疗方剂为羚角钩藤汤《重订通俗伤寒论》（D错）；正气天香散（A错）的功效是行气止痛，为理气药。